阿托品用于解除消化道痉挛时，常可引起口干，属于
A. 副作用
B. 毒性反应
C. 首剂效应
D. 药物本身作用
E. 变态反应

正确答案：A。副作用

解析：本题考查副作用。阿托品用于解除消化道痉挛时，常可引起口干，属于副作用（A对）。副作用是指在药物按正常用法用量使用时，出现的与治疗目的无关的不适反应。如阿托品用于解除胃肠痉挛时，会引起口干、心悸、便秘等副作用。毒性反应（B错）是指在药物剂量过大或体内蓄积过多时发生的危害机体的反应。首剂效应（C错）是指一些患者在初服某种药物时，由于机体对药物作用尚未适应而引起不可耐受的强烈反应，例如哌唑嗪等按照常规剂量开始治疗常可致血压骤降。变态反应（E错）是指机体受药物刺激所发生异常的免疫反应，引起机体生理功能障碍或组织损伤。